虚脉的脉象特征是
A. 轻取不应，推筋着骨始得
B. 轻取无力，按之空虚
C. 轻取不应，重按始得
D. 浮而搏指，中空外坚
E. 若有若无，按之欲绝

正确答案：B。轻取无力，按之空虚

解析：脉象三部举之无力，按之空豁，应指松软是虚脉的脉象特征。气虚不足以运其血，搏动力弱故脉来无力；气虚不敛则脉管松弛，故按之空豁；血虚不能充盈脉管，脉道空虚则脉来无力（B对）。伏脉表现为重按推筋着骨始得，甚则暂伏而不显（A错）。沉脉表现为轻取不应，重按始得，举之不足，按之有余（C错）。革脉的表现为浮而搏指，中空外坚，如按鼓皮（D错）。微脉表现为极细极软，按之欲绝，若有若无（E错）。